浸出制剂使用抑菌剂的说法，正确的有
A. 合剂中山梨酸的用量不得过0.3%
B. 合剂中羟苯酯类的用量不得过0.05%
C. 作为糖浆剂的抑菌剂，山梨酸的最适PH为4.4～4.8
D. 处方的抑菌效力应符合《中国药典》的抑菌效力检查法的规定
E. 糖浆剂中苯甲酸的含量不得过0.25%

正确答案：A、B、C、D。合剂中山梨酸的用量不得过0.3%；合剂中羟苯酯类的用量不得过0.05%；作为糖浆剂的抑菌剂，山梨酸的最适PH为4.4～4.8；处方的抑菌效力应符合《中国药典》的抑菌效力检查法的规定

解析：本题考查浸出制剂的质量要求。下列关于浸出制剂的说法，正确的有合剂中山梨酸的用量不得过0.3%（A对）、合剂中羟苯酯类的用量不得过0.05%（B对）、作为糖浆剂的抑菌剂，山梨酸的最适PH为4.4～4.8（C对）、在制剂确定处方时，该处方的抑菌效力应符合《中国药典》的抑菌效力检查法的规定（D对）。浸出制剂系指用适宜的溶剂和方法浸提中药饮片中有效成分而制成的供内服或外用的一类制剂。浸出制剂常用水或不同浓度的乙醇为溶剂采用适宜的浸提方法制备而成。以水为溶剂的浸出制剂有汤剂、合剂等；以乙醇为溶剂的浸出制剂有药酒、酊剂、流浸膏剂等。合剂质量要求：合剂可以根据需要加入适宜的附加剂。如需加入抑菌剂，除另有规定外，在制剂确定处方时，该处方的抑菌效力应符合《中国药典》抑菌效力检查法的规定，山梨酸和苯甲酸的用量不得超过0.3%（其钾盐、钠盐的用量分别按酸计），羟苯酯类的用量不得超过0.05%，如加入其他附加剂，其品种与用量应符合国家标准的有关规定，不影响成品的稳定性，并应避免对检验产生干扰。必要时可加入适量的乙醇。糖浆剂质量要求：根据需要可加人适宜的附加剂，如需加入抑菌剂，除另有规定外，在制剂确定处方时，该处方的抑菌效力应符合《中国药典》抑菌效力检查法的规定，山梨酸和苯甲酸的用量不得过0.3%（E错）（其钾盐、钠盐的用量分别按酸计），羟苯酯的用量不得过0.05%。防腐效果还与糖浆剂的pH相关。例如，在含糖40%～80%（g/ml）的糖浆剂中用枸橼酸调节pH为3.0～3.5时，苯甲酸对霉菌和酵母菌的抑制作用较强，而山梨酸的最适pH为4.4～4.8。